既能补血，又能活血的药物是
A. 当归
B. 熟地黄
C. 白芍
D. 阿胶
E. 何首乌

正确答案：A。当归

解析：本题考查的是当归的功效。既能补血，又能活血的药物是当归（A对）。当归：【功效】补血活血，调经止痛，润肠通便。熟地黄（B错）：【功效】补血滋阴，补精益髓。白芍（C错）：【功效】养血调经，敛阴止汗，柔肝止痛，平抑肝阳。阿胶（D错）：【功效】补血止血，滋阴润燥。何首乌（E错）：【功效】补益精血，解毒，截疟，润肠通便。